大柴胡汤中配伍黄芩的意义
A. 清泄肺热
B. 清热燥湿，厚肠止利
C. 清热泻火
D. 和解清热，以除少阳之邪
E. 清泄胆热

正确答案：D。和解清热，以除少阳之邪

解析：大柴胡汤方含柴胡、黄芩、大黄、枳实、半夏、白芍、大枣、生姜。其中重用柴胡为君药，配臣药黄芩和解清热，以除少阳之邪（D对）；轻用大黄配枳实以内泻阳明热结，行气消痞，亦为臣药。芍药柔肝缓急止痛，与大黄相配可治腹中实痛，与枳实相伍可以理气和血，以除心下满痛；半夏和胃降逆，配伍大量生姜，以治呕逆不止，共为佐药。大枣与生姜相配，能和营卫而行津液，并调和脾胃，功兼佐使。